男，28岁。右上腹撞伤后腹痛2小时。查体：P140次／分，R24次／分，BP80/40mmHg，神智清，面色苍白，双肺呼吸音清，腹部膨隆，腹式呼吸减弱，全腹压痛，以右上腹为著，伴反跳痛，肝区叩诊（＋），诊断为
A. 右肺损伤
B. 肝脏损伤
C. 右肾损伤
D. 十二指肠损伤
E. 脾脏损伤

正确答案：B。肝脏损伤

解析：患者右上腹撞伤后腹痛2小时（右上主要实质性脏器为肝脏）。查体：P140次／分（心率快），R24次／分（呼吸频率快），BP80/40mmHg（血压低，考虑肝脏损伤，腹腔内出血，导致失血性休克），神智清，面色苍白，双肺呼吸音清，腹部膨隆，腹式呼吸减弱，全腹压痛，以右上腹为著，伴反跳痛，肝区叩诊（＋），考虑肝脏损伤（B对）。右肺损伤（A错）损伤位置应该在右胸，与损伤位置不符，且损伤后呼吸音减弱。右肾损伤（C错）表现为右腰部，不会出现全服压痛反跳痛。十二指肠损伤（D错）一般为长期消化性溃疡导致，左上腹疼，且不会出现在撞击后损伤。脾脏损伤（E错）出血不会迅速出现反跳痛因为血液引起腹膜刺激征较轻。